属于胃黏膜保护剂的是
A. 米索前列醇
B. 哌仑西平
C. 法莫替丁
D. 兰索拉唑
E. 多潘立酮

正确答案：A。米索前列醇

解析：本题考查胃黏膜保护剂。米索前列醇（A对）属于胃黏膜保护剂。哌仑西平（B错）用于消化性溃疡、急性胃黏膜出血及胃泌素瘤。法莫替丁（C错）可显著抑制胃酸分泌，用于缓解胃酸过多所致的胃痛、反酸、胃灼热。兰索拉唑（D错）能够抑制胃酸分泌和防治消化性溃疡，适应证为胃及十二指肠溃疡、胃食管反流病、卓-艾综合征、消化性溃疡急性出血。多潘立酮（E错）具有较强的促胃运动和止吐作用。